下列急性根尖周炎骨膜下脓肿阶段的临床表现除外的是
A. 移行沟变平
B. 体温升高约38℃
C. 根尖部牙龈肿胀局限，呈半球形隆起
D. 白细胞增高
E. 区域淋巴结肿大

正确答案：C。根尖部牙龈肿胀局限，呈半球形隆起

解析：急性化脓性根尖周炎的过程经历三个阶段，其临床表现如下：①根尖周脓肿：自发持续性剧烈跳痛，伸长感加重，触痛重，叩痛（+++），松动Ⅱ～Ⅲ度，患牙根尖部相应的唇、颊侧牙龈潮红，有扪痛、肿胀不明显；②骨膜下脓肿：上述症状加重，患者痛苦面容、根尖区牙龈肿胀明显、移行沟变平，扪痛并有深部波动感；区域淋巴结肿大、压痛，相应面颊部软组织呈反应性水肿；体温可有升高（约38℃）。末梢血象白细胞增多（计数1.0万～1.2万/mm3）。患牙所属区域的淋巴结可出现肿大和扪痛；③黏膜下脓肿：上述症状明显减轻，相应根尖部的牙龈肿胀局限，呈半球形隆起，叩痛（+++），扪诊波动感明显，全身症状缓解。掌握“急性根尖周炎”知识点。